患儿，9岁。全身浮肿，尿少，头晕，头痛，恶心呕吐，舌淡嫩苔白腻，脉弦。其证候是
A. 肺脾气虚
B. 脾肾两虚
C. 风水相搏
D. 水毒内闭
E. 水气上凌心肺

正确答案：D。水毒内闭

解析：患儿以全身浮肿，尿少为突出表现，同时伴有头晕，头痛，恶心呕吐，舌淡嫩苔白腻，脉弦，可诊断为小儿水肿水毒内闭证（D对）。肺脾气虚证症见浮肿不著，或无浮肿，面色少华而苍白，倦怠乏力，易出汗，易感冒，舌苔白，质偏淡，脉缓弱（A错）。脾肾两虚证见面色㿠白，全身浮肿，以腰腹下肢为甚，按之深陷难起（B错）。风水相搏证症见水肿大都先从眼睑开始，继而四肢，甚则全身浮肿，来势迅速，颜面为甚，皮肤光亮，按之凹陷即起，小便少，或有尿血，并有发热、恶风、咳嗽、肢体酸痛，苔薄白，脉浮（C错）。水气上凌心肺证见肢体浮肿，咳嗽，气急，心悸，胸闷，烦躁不能平卧，口唇青紫，指甲发绀，舌苔白或白腻，脉细数无力（E错）。